高温环境中体温调节障碍的主要标志是
A. 出现晕厥
B. 出现休克
C. 皮肤干热
D. 体温降低
E. 体温升高

正确答案：E。体温升高

解析：高温作业对机体生理功能的影响：高温作业时，人体可出现体温调节、水盐代谢、循环系统、消化系统、泌尿系统等方面的适应性变化。主要表现在：体温调节障碍，由于体内蓄热，体温升高（E对）：大量水盐丧失，可引起水盐代谢平衡紊乱，导致体内酸碱平衡和渗透压失调：心率加快，皮肤血管扩张及血管紧张度增加，加重心脏负担，血压下降。但重体力劳动时，血压也可能增加：消化道贫血，胃液分泌减少，胃液酸度减低，淀粉酶活性下降，造成消化不良和其他胃肠道疾病增加：高温条件下，若水盐供应不足可使尿浓缩，增加肾脏负担，有时可见到肾功能不全等：神经系统可出现中枢神经系统抑制，注意力和肌肉的工作能力、动作的准确性和协调性及反应速度的降低等。